薤白的主治病证有
A. 胸痹
B. 结胸
C. 呕吐
D. 胃肠气滞
E. 泻痢里急后重

正确答案：A、D、E。胸痹；胃肠气滞；泻痢里急后重

解析：本题考查的是薤白的主治病证。薤白的主治病证有胸痹（A对）、胃肠气滞（D对）与泻痢里急后重（E对）。薤白：【主治病证】（1）痰浊闭阻胸阳之胸痹证。（2）胃肠气滞，泻痢里急后重。瓜蒌：【主治病证】（1）肺热咳嗽、痰稠不易咳出。（2）胸痹，结胸（B错）。（3）乳痈肿痛，肺痈，肠痈。（4）肠燥便秘。陈皮：【主治病证】（1）脾胃气滞之脘腹胀满或疼痛、嗳气、恶心呕吐（C错）。（2）湿浊中阻之胸闷腹胀、纳呆便溏。（3）痰湿壅肺之咳嗽气喘。